在高科技时代强调医学伦理教育的必要性，最主要的原因在于医学高新技术
A. 给患者带来了福音
B. 促进了医学发展
C. 应用中的双重效应提出了新的医德要求
D. 在西方被严重滥用的教训
E. 应用中出现了许多医德两难选择问题

正确答案：C。应用中的双重效应提出了新的医德要求